顶枕沟位于
A. 大脑半球背外侧面后部
B. 大脑半球背外侧面前部
C. 大脑半球内侧面前部
D. 大脑半球内侧面后部
E. 外侧沟前方

正确答案：D。大脑半球内侧面后部

解析：顶枕沟位于大脑半球内侧面后部（D对）。